以下哪项是《灵枢·天年》中人生三十岁的表现
A. 五脏始定，血气已通，其气在下，故好走
B. 血气始盛，肌肉方长，故好趋
C. 五脏大定，肌肉坚固，血气盛满，故好步
D. 肝气始衰，肝叶始薄，胆汁始灭，目始不明
E. 脾气虚，皮肤枯

正确答案：C。五脏大定，肌肉坚固，血气盛满，故好步

解析：三十岁，五脏已经发育完善，肌肉发达而坚实，血脉充盈旺盛，步履稳健而喜欢从容不迫地行走（C对）；人生长到十岁的时候，五脏发育到一定的健全程度，血气的运行完全畅通均匀，人体生长发育的根源是肾脏的精气，精气从下部而上行，所以喜爱跑动（A错）；二十岁时，血气开始充盛，肌肉也趋于发达，所以行动敏捷，走路很快（B错）；到五十岁的时候，肝气开始衰减，肝叶开始瘦薄，胆汁分泌开始减少，两眼开始昏花（D错）；到七十岁，脾气虚弱，皮肤干枯而不润泽（E错）。